不属于年轻恒牙牙髓特点的有
A. 组织疏松
B. 血运丰富
C. 防御修复机强
D. 渗透作用强
E. 增生现象显著

正确答案：D。渗透作用强

解析：本题考查年轻恒牙牙髓的特点。渗透作用强（D错，为本题的正确答案）为年轻恒牙牙釉质的特点。年轻恒牙根尖孔粗大、牙髓组织疏松（A对），血运丰富（B对），生活力旺盛，因此抗病能力及修复功能都较强（C对）。所以当穿髓孔较大时，足以允许炎症牙髓增生呈息肉状自髓腔内突出（E对）。